某老年患者全口无牙颌进行义齿修复时发现左侧颊系带附着于牙槽嵴顶，影响将来义齿固位，应该采用的治疗措施是
A. 颊系带矫正术
B. 牙槽突修整术
C. 牙槽嵴加高术
D. 不作处理，改变修复方法
E. 不作处理，将来通过调磨义齿，进行缓冲

正确答案：A。颊系带矫正术

解析：舌、唇、颊系带过短或附着过低，影响舌及唇颊运动，并伴发音等功能障碍或影响义齿修复，需行手术矫正。题目明确左侧颊系带附着于牙槽嵴顶，应进行手术矫正。掌握“牙槽外科”知识点。